对于癔症性癫痫，首选的心理治疗方法是
A. 系统脱敏法
B. 精神分析疗法
C. 支持性治疗法
D. 催眠暗示疗法
E. 认知疗法

正确答案：D。催眠暗示疗法

解析：癔症又称歇斯底里、分离障碍。癔症性癫痫，首选的心理治疗方法是催眠暗示疗法（D对）。